男，22岁，剧烈活动时突发心悸1小时。既往体健，查体：BP90/60mmHg，心电图示心室率220次/分，节律较规律，QRS波群时限0.16秒，可见心室获夺和室性融合波，最可能的诊断是
A. 室性心动过速
B. 心房扑动
C. 房性心动过速
D. 窦性心动过速
E. 阵发性室上性心动过速

正确答案：A。室性心动过速

解析：22岁青年男性患者，剧烈活动时突发心悸1小时。既往体健，查体：BP90/60mmHg（低血压），心电图示心室率220次/分（正常值为60～100次/分），节律较规律，QRS波群时限0.16秒（正常QRS波时限＜0.12秒），可见心室获夺和室性融合波（室性心动过速重要诊断依据），综合患者症状及心电图表现，考虑诊断为室性心动过速。心房扑动（B错）心电图特征为：①窦性P波消失，代之以振幅、间距相同的有规律的锯齿状扑动波，称为F波，扑动波之间的等电线消失，频率常为250～350次／分；②心室率规则或不规则；③QRS波形态正常，故不选。房性心动过速（C错）心电图特征包括：①心房率通常为150～200次／分；②P波形态与窦性P波不同；③当房率加快时可出现二度Ⅰ型或Ⅱ房室阻滞，呈现2： 1房室传导者亦属常见，但心动过速不受影响；④P波之间的等电线仍存在（与心房扑动时等电线消失不同）；⑤刺激迷走神经不能终止心动过速，仅加重房室阻滞；⑥发作开始时心率逐渐加速。窦性心动过速（D错）成人窦性心律的频率高于100次／分称为窦性心动过速。阵发性室上性心动（E错）过速刺激迷走神经可减慢或终止发作室性融合波，房性期前收缩促发心室夺获；P波与QRS波群相关，呈1：1比例房室分离。室速多表现为室性融合波、心室夺获、房室分离及全导联QRS波群主波方向呈同向性。